病毒性心肌炎湿毒侵心证宜选用
A. 麻黄连翘赤小豆汤
B. 半夏泻心汤
C. 蒿芩清胆汤
D. 八正散
E. 葛根黄芩黄连汤

正确答案：E。葛根黄芩黄连汤

解析：病毒性心肌炎湿毒侵心证，治宜解毒化湿，宁心安神，首选解表清里的葛根黄芩黄连汤（E对）。麻黄连翘赤豆小汤主治湿热蕴郁于内，外阻经络肌肤之病候（A错）。半夏泻心汤功用寒热平调，散结消痞，主治寒热互结之痞证（B错）。蒿芩清胆汤功用清利湿热，化痰和胃，主治少阳湿热痰浊证（C错）。八正散功用清热泻火，利水通淋，主治热淋（D错）。